脏与腑最根本的区别是
A. 实质性器官和非实质性器官
B. 空腔性脏器和非空腔性脏器
C. 与水谷直接接触和不与水谷直接接触
D. 满而不实与实而不满
E. 贮藏化生精气与传化水谷

正确答案：E。贮藏化生精气与传化水谷

解析：《素问·五藏别论》说：“所谓五脏者，藏精气而不泻也，故满而不能实；六腑者，传化物而不藏，故实而不能也。”五脏的生理功能是化生和贮藏精气，六腑的生理功能是受盛和传化水谷，所以脏与腑最根本的区别是贮藏化生精气与传化水谷（E对）。“满而不实与实而不满”简明概括了五脏、六腑的生理特点（D错）。“满而不实”是强调五脏精气宜充满；所谓“实而不满”是指六腑水谷宜充实而虚实更替。实质性器官和非实质性器官、空腔性脏器和非空腔性脏器都只能说明脏与腑的形态不同（AB错），胆为腑，但它并不与水谷直接接触（C错）。